系统论述医德规范，著有“大医精诚”专论的方书典籍是
A. 《普济方》
B. 《千金翼方》
C. 《备急千金要方》
D. 《太平圣惠方》
E. 《太平惠民和剂局方》

正确答案：C。《备急千金要方》

解析：本题考查的是主要方书典籍。系统论述医德规范，著有“大医精诚”专论的方书典籍是《备急千金要方》（C对）。《备急千金要方》：简称《千金要方》，唐·孙思邈撰著。成书于唐永徽三年（公元652年）。全书30卷。孙氏首重医德，序例中著有“大医习业”“大医精诚”两篇专论。《普济方》（A错）：明•朱橚等撰，公元1390年撰成，1406年刊行。原为168卷，后改为426卷，收方61739首，原有插图239幅，保存了大量的民间验方。是中国古代收方最多的方书，为研究复方用药提供了极为珍贵的资料。朱橚为医药学的发展做出了较大的贡献，使明初及其以前的医药资料得以保存。今有铅印本共十册，仅有文无图。十册铅印本是以《四库全书》版排印，共1960论，2175卷，778法，载方61739首。《千金翼方》（B错）：唐•孙思邈撰著于公元682年。该书是《千金要方》的续编，与《千金要方》相辅相成。全书30卷。该书与《千金要方》对后世中医学发展具有重要的影响。《太平圣惠方》（D错）：宋·王怀隐等编。全书共100卷，分1670门，收方16834首。该书以临床实用为目的，首详诊脉辨阴阳法，次叙处方用药法则，然后按科分叙各科病证和病因、病理以及方药的适应证和药物剂量。因证设方，药随方施，理法方药兼收并蓄。《太平惠民和剂局方》（E错）：简称《和剂局方》《局方》，宋代太医局编。全书10卷。该书为宋代官府颁行，是我国第一部成药典。该书对后世影响颇大，其所载方剂至今在临床上多有应用。